能产生高血钾的是
A. 呋塞米
B. 螺内酯
C. 氢氯噻嗪
D. 氨苯蝶啶
E. 甘露醇

正确答案：B。螺内酯

解析：螺内酯（B对）是醛固酮的竞争性拮抗药，从而使醛固酮的保钠排钾的作用减弱，进而产生高血钾。氨苯蝶啶（P217）是肾小管上皮细胞钠离子通道抑制药，也是潴钾利尿剂，也可致高钾血症（D对），故本题不严谨。呋塞米是袢利尿剂，氢氯噻嗪是噻嗪类利尿剂（AC错），二者均可导致低钾血症。甘露醇（E错）是渗透性利尿剂，其对血钾无影响。